实脾散的功用
A. 健脾和胃，消食止泻
B. 益气健脾，渗湿止泻
C. 健脾和胃，消痞除满
D. 温阳健脾，行气利水
E. 燥湿运脾，行气和胃

正确答案：D。温阳健脾，行气利水

解析：实脾散功效为温阳健脾，行气利水（D对），方中附子温补肾阳以助化气行水，干姜温运脾阳以助运化水湿，茯苓白术健脾和中，渗湿利水，木瓜除湿醒脾和中，厚朴木香大腹子行气导滞，化湿利水，草果温中燥湿，甘草生姜大枣益脾和中，本方温阳与健脾同用，脾肾同治，重在实脾以治制水，行气于利水共行，为治疗脾肾阳虚，水气内停之阴水。